病人瞳孔移向内侧是何神经受损所致
A. 动限神经
B. 滑车神经
C. 展神经
D. 眼神经
E. 无

正确答案：C。展神经

解析：动眼神经（A错）损伤导致瞳孔斜向外下方。滑车神经（B错）损伤导致瞳孔移向上外方。展神经（C对）支配外直肌，损伤后产生内斜视。眼神经（D错）不支配眼内肌。